股动脉在腹股沟韧带
A. 深面续于髂内动脉
B. 深面续于髂外动脉
C. 浅面续于髂外动脉
D. 深面续于髂总动脉
E. 浅面发出股深动脉

正确答案：B。深面续于髂外动脉

解析：股动脉在腹股沟韧带深面续于髂外动脉（B对），髂外动脉经腹股沟韧带中点的深面至股前部，移行为股动脉。